腰部冷痛沉重
A. 肾虚
B. 瘀血
C. 寒湿
D. 阳虚
E. 阴虚

正确答案：C。寒湿

解析：寒湿腰痛见腰部冷痛沉重，阴雨天加重（C对）。肾虚腰痛见腰部经常绵绵作痛，酸软无力（A错）。瘀血腰痛见腰部刺痛，或痛连下肢（B错）。肾阳虚腰痛见腰膝酸冷疼痛（D错）。肾阴虚腰痛见腰酸而痛伴遗精、经少、头晕耳鸣（E错）。